某女，35岁。症见腰脊疼痛、四肢关节冷痛。医师诊断为痹病，证属寒湿痹阻经络，宜选用的中成药是
A. 仙灵骨葆胶囊
B. 独活寄生丸
C. 痛风定胶囊
D. 风湿骨痛丸
E. 天麻丸

正确答案：D。风湿骨痛丸

解析：本题考查风湿骨痛丸的主治。医师诊断为痹病，证属寒湿痹阻经络，宜选用的中成药是风湿骨痛丸（D对）。风湿骨痛丸（胶囊）【主治】寒湿痹阻经络所致的痹病，症见腰脊疼痛、四肢关节冷痛；风湿性关节炎见上述证候者。仙灵骨葆胶囊（A错）【主治】肝肾不足，瘀血阻络所致的骨质疏松症，症见腰脊疼痛、足膝酸软、乏力。独活寄生合剂（丸）（B错）【主治】风寒湿痹阻、肝肾两亏、气血不足所致的痹病，症见腰膝冷痛、屈伸不利。痛风定胶囊（C错）【主治】湿热瘀阻所致的痹病，症见关节红肿热痛，伴有发热、汗出不解、口渴心烦、小便黄，舌红、苔黄腻、脉滑数；痛风见上述证候者。天麻丸（E错）（片）【主治】风湿瘀阻、肝肾不足所致的痹病，症见肢体拘挛、手足麻木、腰腿酸痛。